被修复牙齿临床牙冠过短，会影响到修复的美观效果应行
A. 拔除
B. 正畸治疗
C. 牙槽骨成形术
D. 临床牙冠延长
E. 咬合调整与选磨

正确答案：D。临床牙冠延长

解析：本题考查修复前准备。被修复牙齿临床牙冠过短，与邻牙龈缘曲线不协调时，会影响到修复的美观效果，应考虑临床牙冠延长（D对）处理。